描述正确的是
A. 逆温有利于大气污染物的扩散
B. 山谷有利于大气污染物的扩散
C. 形成温室效应的主要污染物是CO
D. 一天中光化学烟雾污染最重的时段为凌晨
E. 可吸入颗粒物与飘尘是同一个概念

正确答案：E。可吸入颗粒物与飘尘是同一个概念

解析：本题考查可吸入颗粒物。可吸入颗粒物指空气动力学直径≤10μm的颗粒物，因其能进入人体呼吸道而命名之，又因其能够长期漂浮在空气中，也被称为飘尘（E对ABCD错）。